对于诊断甲状腺癌最有意义的临床表现除甲状腺肿物外，还伴有
A. 吞咽困难
B. 声音嘶哑
C. 体重减轻
D. 明显疼痛
E. 明显憋气

正确答案：B。声音嘶哑

解析：诊断甲状腺癌最有意义的临床表现除甲状腺肿物外，还伴有声音嘶哑（B对）等压迫症状。